男，26岁。饱餐后剧烈运动时腹痛2小时，持续性痛阵发性加剧，脐周伴腰背痛，呕吐频繁，呕后症状无缓解，腹肌紧张，脐周有压痛及反跳痛，肠鸣音亢进，有气过水声。该病人需要首先静脉输入
A. 血浆
B. 代血浆
C. 全血
D. 等渗糖盐水
E. 复方氨基酸

正确答案：D。等渗糖盐水

解析：患者饱餐后剧烈运动，出现持续性痛阵发性加剧，脐周伴腰背痛，呕吐频繁，吐后症状无缓解，腹肌紧张，脐周有压痛及反跳痛，肠鸣音亢进，有气过水声等症状，提示为小肠扭转早期。小肠扭转好发于青壮年，常由饱餐后剧烈活动诱发，常突发持续性腹部剧痛，并有阵发性加重，先有脐周疼痛，可放射至腰背部，呕吐频繁，腹部膨胀明显，可闻及气过水声，早期肠鸣音亢进，晚期肠鸣音减弱。小肠扭转时肠系膜血液循环受阻，大量体液渗出，为补足血容量应首选等渗糖盐水（平衡盐液）（D对）。患者肠鸣音亢进，为机械性肠梗阻的表现，说明小肠虽然发生扭转但仍未发展为绞窄性肠梗阻，暂不需输入血浆（A错）、代血浆（B错）、全血（C错）。复方氨基酸（E错）主要用于治疗缺乏必需氨基酸所引起的疾病或作为体弱者的营养补充。